因中气下陷所致的久痢、脱肛及子宫下垂，都可采用升提中气法治疗。此属于
A. 因人制宜
B. 同病异治
C. 异病同治
D. 审因论治
E. 虚则补之

正确答案：C。异病同治

解析：因中气下陷所致的久痢、脱肛及子宫下垂等不同的病变，在其发展过程中，均可出现“中气下陷”的病机，表现为大致相同的证，都可采用升提中气法治疗，这是异病同治（C对）。因人制宜（A错）是根据病人的年龄、性别、体质等不同特点，来制订适宜的治疗原则。同病异治（B错）是指同一种病，由于发病时间、地域不同，或所处的疾病的阶段或类型不同，或患者的体质有异，故反映出的证不同，因而治疗也有异。审因论治（D错）是审查病因，根据病因来治疗。虚则补之（E错）是指虚损性病证出现虚象，用具有补益作用的方药来治疗，即以补益药治虚证。